ATⅡ受体抑制剂是
A. 尼群地平
B. 硝苯地平
C. 氨氯地平
D. 尼莫地平
E. 氯沙坦

正确答案：E。氯沙坦